全口义齿取模前上颌托盘需盖过两侧翼上颌切迹，后缘应超过颤动线
A. 1～2mm
B. 2～3mm
C. 3～4mm
D. 4～5mm
E. 5mm以上

正确答案：C。3～4mm

解析：本题考查对上颌无牙颌印模范围和上颌全口义齿基托后缘位置的要求。上颌总义齿后缘的正确位置应在翼上颌切迹与腭小凹后2mm的连线上，即后颤动线处。因此，上颌无牙颌成品托盘的后缘应超过腭小凹和颤动线位置，印模范围应取至腭小凹后3～4mm（C对），以保证在准确的石膏模型上确定义齿基托后缘和制作后堤区。